按分散系统分类，薄荷水属液体制剂的类型是
A. 溶胶剂
B. 高分子溶液剂
C. 乳剂
D. 混悬剂
E. 低分子溶液剂

正确答案：E。低分子溶液剂

解析：本题考查的是溶液剂的分类。按分散系统分类，薄荷水属液体制剂的类型是低分子溶液剂（E对）。薄荷水属于芳香水剂。低分子溶液剂：系指小分子药物以分子或离子状态分散在溶剂中形成的均相液体制剂。所形成的分散体系均匀、透明并能通过半透膜，可供内服或外用。常用的有溶液剂、芳香水剂、甘油剂、醑剂等。芳香水剂：系指芳香挥发性药物（多为挥发油）的饱和或近饱和水溶液，也可用适宜浓度的乙醇为溶剂制成浓芳香水剂。含挥发性中药经水蒸气蒸馏制备而成的澄明液体制剂又称为露剂。薄荷水：【注解】薄荷油在水中的溶解度为0.05%，滑石作为薄荷油的分散剂，共研时可使挥发油吸附在滑石粉颗粒周围，加水振摇时，易使挥发油均匀分布于水中以增加溶解度。同时滑石粉还具有吸附作用，过量的挥发油过滤时因吸附在滑石粉表面而被去除，起到助滤作用。溶胶剂（A错）系指固体药物以多分子聚集体分散于水中形成的非均相的液体制剂，亦称疏水胶体溶液。高分子溶液剂（B错）系指高分子化合物溶解于溶剂中制成的均匀分散的液体制剂，属于热力学稳定体系。乳剂（C错）系指两种互不相溶的液体，经乳化制成的一种液体以液滴状态分散于另一相液体中形成的非均相分散体系的液体制剂。混悬剂（D错）系指难溶性固体药物以微粒状态分散于分散介质中形成的非均相的液体制剂，也包括干混悬剂。